患儿发热持续不退2个月，午后发热较高，适逢夏季，气温愈高，发热愈高，口渴多饮，皮肤灼热无汗，口唇干燥，小便频数，量多，舌红，脉数。治疗应首选
A. 新加香薷饮
B. 白虎汤
C. 王氏清暑益气汤
D. 温下清上汤
E. 竹叶石膏汤

正确答案：C。王氏清暑益气汤

解析：患者适逢夏季发热，持续不退2个月，气温愈高，发热愈高，口渴多饮，皮肤灼热无汗，小便频数，量多，符合夏季热长期发热、口渴多饮、多尿、少汗或汗闭的特征。暑气内迫肺胃，耗气伤津，暑伤肺气见发热、汗闭、多尿；暑伤胃津见口渴、多饮，舌脉亦符合暑伤肺胃之征象，治宜清暑益气，养阴生津，用王氏清暑益气汤加减（C对）。新加香薷饮功可清暑解表，用于治疗暑邪感冒（A错）。白虎汤具有清气分热，清热生津之功，用于气分热盛证，壮热面赤，烦渴引饮，汗出恶热，脉洪大有力（B错）。温下清上汤功可温补肾阳，清心护阴，用于夏季热之上盛下虚证（D错）。竹叶石膏汤功可清热生津，用于夏季热暑伤肺胃证兼见烦渴欲呕，舌红苔少（E错）。